对不稳定型心绞痛是否发生了微小心肌损伤，有确诊价值的是
A. CK-MB
B. cTnT
C. LDH
D. FABP
E. Mb

正确答案：B。cTnT

解析：因cTnT特异性较高，所以对不稳定型心绞痛是否发生了微小心肌损伤，有确诊价值的是cTnT（B对）。CK-MB（A错）对再发心肌梗死的诊断有重要价值，此外CK-MB高峰时间与预后有一定关系。LDH（C错）是乳酸脱氢酶，其对心肌梗死的诊断具有较高的灵敏度，但特异性较差。FABP（D错）是脂肪酸结合蛋白，其存在于多种组织中，以心肌和骨骼肌中的含量最丰富，可用于监测溶栓治疗效果。Mb（E错）为肌红蛋白，其存在于骨骼肌和心肌中，对诊断急性心肌梗死和骨骼肌损害有一定的价值。